颈椎
A. 第6颈椎横突末端前方有颈动脉结节
B. 横突孔只存在于第1-6颈椎
C. 第1~7颈椎棘突末端均分叉
D. 椎弓均发出7个突起
E. 无

正确答案：A。第6颈椎横突末端前方有颈动脉结节

解析：第6颈椎横突末端前方有明显的隆起，称颈动脉结节，颈总动脉经其前方（A对）。横突孔除了存在于第1-6颈椎，也存在于第七颈椎（B错）。第 7 颈椎又名隆椎, 棘突长，末端不分叉（C错）。第 1 颈椎又名寰椎, 呈环状，无椎体、棘突和关节突（D错）。